对脑和长骨的发育最为重要的
A. 生长素
B. 性激素
C. 促甲状腺激素
D. 甲状腺激素
E. 维生素D₃

正确答案：D。甲状腺激素